口服给药较适用于
A. 病情危急的患者
B. 慢性病或轻症患者
C. 胃肠反应大的患者
D. 吞咽困难的老年人
E. 吞咽能力差的婴幼儿

正确答案：B。慢性病或轻症患者

解析：本题考查给药途径的选择。慢性病或轻症患者（B对）用药期较长，对药物起效时间无过高要求，适宜选用口服给药。病情危急的患者（A错）治疗时要求药物迅速起效，宜选择静脉注射、静脉滴注、肌内注射、吸入及舌下给药方式。胃肠反应大的患者（C错）宜选择静脉注射、肌内注射等给药方式。口服给药需要吞服片剂等药物，不适宜吞咽能力差的老年人及婴幼儿（DE错）。